风寒袭络型落枕，除主穴外应配用
A. 风池、肩井
B. 血海、肩井
C. 风池、合谷
D. 大椎、束骨
E. 内关、合谷

正确答案：C。风池、合谷

解析：风池疏调头部气机，还可平肝潜阳；合谷以祛邪解表；故选用风池和合谷（C对）。肩井祛风清热，活络消肿，治疗颈项强痛，肩背疼痛，上肢不遂，妇产科及乳房疾患、瘰疬（A错）。血海可以活血化瘀，补血养血，引血归经（B错）。大椎能振奋阳气，驱邪外出；束骨祛风热、利项背（D错）。内关宽胸解郁，行气止痛（E错）。